对青光眼、前列腺肥大者禁用的药品是
A. 谷维素
B. 色甘酸钠
C. 羧甲司坦
D. 氢溴酸东莨菪碱
E. 硫糖铝

正确答案：D。氢溴酸东莨菪碱

解析：本题考查氢溴酸东莨菪碱的禁忌症。对青光眼、前列腺肥大者禁用的药品是氢溴酸东莨菪碱（D对）；胃及十二指肠溃疡患者慎用谷维素（A错）；对色甘酸钠过敏者、妊娠三个月以内的妇女禁用色甘酸钠（B错）；消化道溃疡患者禁用羧甲司坦（C错）；习惯性便秘者慎用硫糖铝（E错）。